长效苯二氮䓬类药物是
A. 三唑仑
B. 艾司唑仑
C. 地西泮
D. 劳拉西泮
E. 硝西泮

正确答案：C。地西泮

解析：常用苯二氮䓬类药物分类及作用特点-长效类：地西泮（C对）、氟西泮、夸西泮。